口服复方避孕药的禁忌证有
A. 哺乳期
B. 乳腺癌
C. 急性肝炎
D. 哮喘
E. 深静脉血栓病史

正确答案：A、B、C、E。哺乳期；乳腺癌；急性肝炎；深静脉血栓病史

解析：本题考查口服复方避孕药的禁忌症。口服复方避孕药的禁忌症有：哺乳期（A对）、乳腺癌（B对）、急性肝炎（C对）、深静脉血栓病史（E对）。复方避孕药适应人群及禁忌：（1）适应人群：要求避孕的健康育龄女性，且无使用甾体激素避孕药禁忌，均可选用。（2）禁忌：妊娠状态；产后21天以内；血栓性静脉炎或血栓栓塞性疾病；心脑血管疾病；血管因素所致高血压；血压>160/100mmHg；确诊或可疑乳腺癌；确诊或可疑雌激素依赖性肿瘤；良、恶性肝脏肿瘤；缺血性心脏病，复杂的瓣膜性心脏病；中至重度心脏功能受损，正常或轻度心脏功能受损<6个月；严重肝硬化、肝功能损伤，病毒性肝炎活动期；原因不明的阴道异常出血；吸烟（特别是年龄>35岁的女性）；严重偏头痛；肾脏疾病，肾功能损伤；大手术后；系统性红斑狼疮伴抗磷脂抗体阳性。此外，使用利托那韦等蛋白酶抑制剂；使用某些抗惊厥剂（苯妥英钠、卡马西平、巴比妥类、扑米酮、托吡酯、奥卡西平、拉莫三嗪），抗微生物治疗药物（利福平、利福布汀）等情况时，使用复方避孕药的风险可能或已证实大于获益。